患儿，3岁，体重13kg，近1个月来食欲不振，面色少华，倦怠乏力，大便偏稀，夹有不消化食物，舌质淡、苔薄白。应首先考虑的诊断是
A. 厌食，脾胃气虚证
B. 积滞，脾虚夹积证
C. 蛋白质-能量营养不良，疳气证
D. 营养性缺铁性贫血，脾胃虚弱证
E. 小儿腹泻，伤食泻

正确答案：A。厌食，脾胃气虚证

解析：患儿以长期食欲不振为主症，故诊断为厌食。胃主受纳，脾主运化，胃气不和，纳谷不香，故食欲不振；脾虚失运，后天生化乏源，脏腑失于濡养，故面色少华，倦怠乏力；脾不健运，则消化、吸收传送功能失常，故大便偏稀，夹有不消化食物；舌质淡、苔薄白，为气虚之象，故其证型为脾胃气虚证（A对）。积滞是指小儿内伤乳食，停聚中焦，积而不化，气滞不行所形成的一种胃肠疾患，以不思乳食，食而不化，脘腹胀满，嗳气酸腐，大便溏薄或秘结为临床特征（B错）。蛋白质-能量营养不良是以能量和（或）蛋白质缺乏，为主导的一种营养缺乏性疾病，临床以体重明显减轻、皮下脂肪减少和皮下水肿为特征（C错）。营养性缺铁性贫血临床表现为起病缓慢，皮肤黏膜逐渐苍白，以口唇和甲床等处明显，易疲乏，食欲减退，常有异食癖，精神不振，注意力不集中，记忆力减退，年长儿可自诉头晕，眼前发黑等症状（D错）。小儿腹泻临床以大便次数增多和大便性状改变为特点（E错）。